在旋前运动时
A. 运动轴通过桡骨的垂直轴
B. 桡、尺两骨均旋转
C. 手掌向前
D. 桡骨下端围绕尺骨头旋转
E. 无

正确答案：D。桡骨下端围绕尺骨头旋转

解析：桡尺远、近侧关节是联合关节，在旋前运动时，旋转轴为通过桡骨头中心至尺骨头中心的连线（A错）。运动时，桡骨头在原位自转，而桡骨下端连同关节盘围绕尺骨头旋转(D对），即只有桡骨在作旋转运动（B错）。当桡骨转至尺骨前方并与之相交叉时，手背向前（C错），称为旋前；与此相反的运动，即桡骨转回到尺骨外侧，称为旋后。